支气管扩张的典型临床表现为
A. 慢性咳嗽、痰中带血，伴胸痛、杵状指，病变部位可有湿啰音
B. 慢性咳嗽、咳白色泡沫痰，很少咯血，双肺可有干湿啰音
C. 慢性咳嗽、咳大量脓血痰，反复高热，病变部位可有湿啰音
D. 慢性咳嗽、咳大量脓痰，或反复咯血，病变部位湿啰音
E. 慢性咳嗽，常伴低热、盗汗、咯血，上肺可有湿啰音

正确答案：D。慢性咳嗽、咳大量脓痰，或反复咯血，病变部位湿啰音

解析：支气管扩张多见于儿童和青年，大多继发于急、慢性呼吸道感染和支气管阻塞后，反复发生支气管炎症、致使支气管壁结构破坏，引起支气管异常和持久性扩张，临床表现主要为慢性咳嗽、咳大量脓痰和反复咯血（A错），病变重可闻及下胸部、背部固定而持久的局限性粗湿啰音（D对）。慢性咳嗽，常伴低热、盗汗、咯血，上肺可有湿啰音是肺结核的临床表现（E错）。慢性咳嗽咳白色泡沫痰，很少咯血，双肺可有干湿啰音（B错）是慢性左心衰的临床表现。慢性咳嗽咳大量脓血痰，反复高热，病变部位可有湿啰音（C错）是肺脓肿的临床表现。